在八会穴中，髓会是
A. 中脘
B. 膻中
C. 阳陵泉
D. 太渊
E. 悬钟

正确答案：E。悬钟

解析：八会穴，即脏会章门、腑会中脘（A错）、气会膻中（B错）、血会膈俞、筋会阳陵泉（C错）、脉会太渊（D错）、骨会大杼、髓会悬钟（E对）。